有关肝癌的临床表现，下列哪项不正确
A. 可完全不痛或仅有轻微钝痛
B. 不会出现急腹症表现
C. 有时表现为膈抬高
D. 位于肋弓下的癌结节最易被触到
E. 有时可在腹壁上听到吹风样血管杂音

正确答案：B。不会出现急腹症表现